男，1岁。面色苍白1个月，易疲乏，时而烦躁，纳差。体检：肝肋下3cm，质中，脾肋下1.5cm。查血常规：Hb86g/L，RBC3.45×10¹²/L，MCV68fL，MCH20pg，MCHC0.26。最可能的诊断是
A. 叶酸缺乏性贫血
B. 再生障碍性贫血
C. 缺铁性贫血
D. VitB₁₂缺乏性贫血
E. 生理性贫血

正确答案：C。缺铁性贫血

解析：患儿面色苍白、肝脾肿大，提示有贫血。6个月－6岁儿童血红蛋白小于110g/L可诊断为贫血；贫血细胞的形态分类有三个指标，红细胞平均容积（MCV）正常值80-94fl，红细胞平均血红蛋白（MCH）正常值28-32pg，红细胞平均血红蛋白浓度（MCHC）正常值32-38%。血常规提示血红蛋白低，MCV＜80fl，MCH＜28pg，MCHC＜0.32，提示患儿为小细胞低色素贫血，叶酸缺乏性贫血和VitB12 缺乏性贫血属于巨幼细胞贫血（AD错），再障属于正细胞性贫血（B错），生理性贫血呈自限性，多见于新生儿，且Hb多在100g/L左右（E错）。因此因诊断为缺铁性贫血（C对）。